酚醛树脂的成分中加入氢氧化钠的作用是
A. 加速树脂的聚合
B. 提高塑化液的流动性
C. 增加塑化液的渗透性
D. 增加抑菌作用
E. 以上都不对

正确答案：A。加速树脂的聚合

解析：本题考查酚醛树脂中加入氢氧化钠的作用。酚醛树脂中加入强碱氢氧化钠，在强碱性条件下，酚醛树脂的主要成分间苯二酚和甲醛，能加速树脂的聚合（A对）。提高塑化液的流动性（B错）、增加塑化液的渗透性（C错）可以通过增加酚醛树脂塑化液的温度实现，塑化液温度高时流动性好，能渗透到根管侧支、副根管中。可以通过增加塑化液中的95%乙醇含量实现增加酚醛树脂抑菌作用（D错），因为95%乙醇具有抑菌作用。